不按规定使用麻醉药品、精神药物，情节严重的，由卫生行政部门给予的处理是
A. 暂停执业活动3～6个月
B. 暂停执业活动六个月至一年
C. 给予行政处分
D. 吊销医师执业证书
E. 追究刑事贵任

正确答案：D。吊销医师执业证书

解析：不按规定使用麻醉药品、精神药物，情节严重的，由县级以上人民政府卫生行政部门吊销其执业证书（D对B错）。题干中并未说明构成犯罪的，因而不构成追究刑事责任的处罚（E错）。